关于寿命表，下列说法正确的是
A. 简略寿命表中，期望寿命应随着年龄的增加而减少，所以e₀总是大于e₁
B. 不同地区的平均期望寿命不能直接比较
C. 生存概率是指X岁存活者预期今后可以存活的平均岁数
D. 期望寿命不受年龄构成的影响

正确答案：D。期望寿命不受年龄构成的影响

解析：本题考查寿命表的相关内容。期望寿命的大小取决于年龄别死亡率高低，与年龄构成无关（D对），两地的期望寿命可以直接比较（B错）。简略寿命表中，期望寿命也可能会随着年龄的增加而增加，e₁反而可能高于e₀（A错）。生存概率是指X岁尚存者在今后l年内存活的概率（C错）。